根据七情内伤致病理论，思虑太过可导致
A. 气上
B. 气结
C. 气消
D. 气下
E. 气乱

正确答案：B。气结

解析：本题考查的是七情内伤。根据七情内伤致病理论，思虑太过可导致思则气结（B对）。七情，即喜、怒、忧、思、悲、恐、惊七种情志变化。在一般情况下，七情是人体对客观外界事物的不同反映，属正常的情志活动，并不能成为致病因素。只有突然、强烈或长期持久的情志刺激，才能影响人体的生理活动，使脏腑气血功能紊乱，从而引起疾病的发生。七情异常是直接影响内脏功能，造成气机紊乱而发病的因素，故又称“内伤七情”，属于内伤病的一类致病因素。七情内伤致病影响内脏气机：情志所伤，主要影响脏腑气机，使其紊乱。主要的病变变化是：“怒则气上（A错）”“喜则气缓”“悲则气消（C错）”“恐则气下（D错）”“惊则气乱（E错）”“思则气结”。怒则气上，是指过度愤怒，则可使肝气疏泄太过，气机上逆，甚则血随气逆，并走于上。可见头胀头痛、面红目赤、呕血，甚则昏厥猝倒等。喜则气缓，是指过喜或暴喜，则可使心气涣散而不收。在正常情况下，心情喜悦，气血调和，能缓和精神紧张；但暴喜或过喜，则又可使心气涣散，神不内守。表现为精神不能集中，甚则神志失常，狂乱，或见心气暴脱的大汗淋漓、气息微弱、脉微欲绝等症。悲则气消，是指过度悲忧，则可使肺气抑郁，意志消沉，从而使肺气耗伤。可见精神不振、气短胸闷、乏力懒言等症。恐则气下，是指恐惧过度，因恐而伤及肾气，肾气不固，可见二便失禁；或恐惧不解，肾精不固，而发生骨酸痉厥、遗精等病症。惊则气乱，是指突然受惊，以致心无所倚，神无所归，虑无所定。可见精神不安、惊慌失措，或遇事犹豫不决等症。思则气结，是指思虑劳神过度，伤及于脾，使脾不健运，运化无力，气血化生无源。若耗及于心，则心血亏虚，心神失养，表现为心悸、健忘、失眠、多梦；若脾运不健，又可影响胃纳，可见食欲减退、脘腹胀满或腹泻便溏等症。